在女性，输尿管盆段在进入膀胱前，跨其前上方者为
A. 髂内动脉
B. 卵巢动脉
C. 子宫动脉
D. 闭孔神经
E. 闭孔动脉

正确答案：C。子宫动脉

解析：女性输尿管进入膀胱前从子宫动脉（C对）后下方绕过。